参与溶血症的抗体是
A. lgA
B. IgD
C. IgG
D. IgE
E. IgM

正确答案：C。IgG

解析：新生儿溶血症：可因母子间Rh血型不符引起。血型为Rh-（RhD基因缺失）的母亲由于输血、流产或分娩等原因接受红细胞表面Rh抗原刺激后，可产生抗RhIgG类抗体。当该母亲再次妊娠，且胎儿血型为Rh+时，母体内的Rh抗体通过胎盘进入胎儿，与其红细胞结合使之溶解破坏，引起流产或新生儿溶血。产后72小时内，注射Rh抗体及时清除进入母体内的RH+红细胞，有效预防再次妊娠时发生新生儿溶血症。掌握“概述及Ⅰ型超敏反应”知识点。